患者，女，40岁。左颞下颌关节运动时可闻磨砂玻璃样杂音，伴关节区持续疼痛。X线片示：髁突表面骨皮质不连续。该患者首先考虑的诊断是
A. 颞肌痉挛
B. 翼外肌痉挛
C. 翼外肌功能亢进
D. 骨关节病
E. 关节盘穿孔

正确答案：D。骨关节病

解析：骨关节病主要症状是在关节运动中有连续的摩擦音，有的似揉玻璃纸音。有的患者伴有张口受限，开口痛、咀嚼痛等症状。X线片可见关节骨硬化、破坏、骨质增生等。掌握“颞下颌关节紊乱”知识点。